培养儿童养成良好的口腔卫生习惯是以下哪个年龄段的儿童口腔保健的目的
A. 0～2岁儿童
B. 3～6岁儿童
C. 6～8岁儿童
D. 8～10岁儿童
E. 10～12岁儿童

正确答案：B。3～6岁儿童

解析：3～6岁儿童，由于年纪小，注意力集中时间短，儿童无法自主完成口腔清洁。此时口腔保健的目的是培养儿童养成良好的口腔卫生习惯。掌握“学龄儿童口腔保健”知识点。